女，28岁，既往月经规律，现停经45天，发现阴道流出少量咖啡色物2天，无腹痛，尿hCG（+）。对确诊最有帮助的检查是
A. 血β-hCG
B. 血常规
C. B超检查
D. 妇科检查
E. 测定基础体温

正确答案：C。B超检查

解析：B型超声检查：对疑为先兆流产者（C对），根据妊娠囊的形态，有无胎心搏动，确定胚胎或胎儿是否存活，以指导正确的治疗方法。若妊娠囊形态异常或位置下移，预后不良。